传染病复发最常见于
A. 流行性出血热
B. 流行性脑膜炎
C. 伤寒
D. 斑疹伤寒
E. 乙型脑炎

正确答案：C。伤寒